不属于麻醉药品和精神药品，但按处方药管理，药品零售企业必须凭处方调剂的是
A. 单味罂粟壳
B. 复方磷酸可待因溶液
C. 按非处方药管理的含麻黄碱类复方制剂
D. 复方甘草片

正确答案：D。复方甘草片

解析：本题考查含特殊药品复方制剂的零售管理。不属于麻醉药品和精神药品，但按处方药管理，药品零售企业必须凭处方调剂的是复方甘草片（D对）。含特殊药品复方制剂的药品零售管理：因为含特殊药品复方制剂不是特殊管理药品，所以公众在零售药店是可以购买到的。但是，根据国家药品监督管理部门的相关规定，部分含特殊药品复方制剂零售有一定的管理限制。药品零售企业销售含特殊药品复方制剂时，处方药应当严格执行处方药与非处方药分类管理有关规定，复方甘草片、复方地芬诺酯片列入必须凭处方销售的处方药管理，严格凭医师开具的处方销售；除处方药外，非处方药一次销售不得超过5个最小包装（含麻黄碱复方制剂另有规定除外）。自2015年5月1日起，含可待因复方口服液体制剂（B错）（包括口服溶液剂和糖浆剂）已列入第二类精神药品管理。具有经营资质的药品零售企业，销售含可待因复方口服液体制剂时，必须凭医疗机构使用精神药品专用处方开具的处方销售，单方处方量不得超过7日常用量。复方甘草片、复方地芬诺酯片应设置专柜由专人管理、专册登记，上述药品登记内容包括：药品名称、规格、销售数量、生产企业、生产批号。药品零售企业销售含特殊药品复方制剂时，如发现超过正常医疗需求，大量、多次购买上述药品的，应当立即向当地药品监督管理部门报告。罂粟壳（A错），必须凭盖有乡镇卫生院以上医疗机构公章的医生处方配方使用，不准生用，严禁单味零售，处方保存3年备查。含麻黄碱类复方制剂（C错）的零售管理：药品零售企业销售含麻黄碱类复方制剂，应当查验购买者的身份证，并对其姓名和身份证号码予以登记。除处方药按处方剂量销售外，一次销售不得超过2个最小包装。